动脉韧带位于
A. 主动脉和肺动脉的起始处
B. 右肺动脉起始部和上腔静脉之间
C. 左肺动脉起始部和主动脉弓下缘之间
D. 胸主动脉起始部和主动脉弓下缘之间
E. 主动脉升部和上腔静脉之间

正确答案：C。左肺动脉起始部和主动脉弓下缘之间

解析：左肺动脉起始部和主动脉弓下缘之间（C对）的纤维性结缔组织索为动脉韧带。